女，12岁，三周前患急性扁桃体炎。突然出现窦性心动过速，心搏微弱，心尖区有收缩期吹风样杂音，实验室检查有链球菌感染，确诊为急性风湿热，除用青霉素控制链球菌感染外，应选哪种药治疗
A. 阿司匹林
B. 布洛芬
C. 对乙酰氨基酚
D. 保泰松
E. 吲哚美辛

正确答案：A。阿司匹林

解析：阿司匹林：①镇痛作用；②消炎作用；③解热作用：可能通过作用于下视丘体温调节中枢引起外周血管扩张，皮肤血流增加、出汗、使散热增加而起解热作用，此种中枢性作用可能与前列腺素在下视丘的合成受到抑制有关；④抗风湿作用；⑤对血小板聚集的抑制作用：是通过抑制血小板的前列腺素环氧酶、从而防止血栓烷A2的生成而起作用(TXA2可促使血小板聚集)。此作用为不可逆性。掌握“阿司匹林”知识点。